患者女，16岁，不可自控的间断性大量饮食、情绪不稳半年，早期大量饮食后担心发胖主动刺激咽部诱发呕吐，后期大量进食后不用催吐亦呕吐，体重无明显减轻，月经不规律，坚持上学。查体及实验室检查无阳性结果。胃镜检查示浅表性胃炎，该患者的主要诊断是
A. 浅表性胃炎
B. 双向障碍
C. 神经性呕吐
D. 神经性厌食
E. 神经性贪食

正确答案：E。神经性贪食

解析：神经性厌食是指有意节制饮食,导致体重明显低于正常标准的一种进食障碍（D错）；对神经性贪食（E对）对食物有种不可抗拒的欲望；难以克制的发作性暴食。